6岁儿童，右下第一恒磨牙已经完整萌出，窝沟较深，医生决定对该牙进行封闭，操作过程中，采用含磷酸的凝胶酸蚀后，需要用水枪加压冲洗牙面的时间是
A. 5秒内即可
B. 5～9秒
C. 10～15秒
D. 20～30秒
E. 40～60秒

正确答案：D。20～30秒

解析：本题考查窝沟封闭术。6岁儿童，右下第一恒磨牙已经完整萌出，窝沟较深，医生决定对该牙进行封闭，操作过程中，采用含磷酸的凝胶酸蚀后，需要用水枪加压冲洗牙面的时间是20～30秒（D对）。窝沟封闭时，酸蚀后需用蒸馏水彻底冲洗，通常用水枪或注射器加压冲洗牙面10～15秒，边冲洗边用排唾器吸干，去除牙釉质表面的酸蚀剂和反应产物。如用含磷酸的凝胶酸蚀，冲洗时间应加倍，因此为20～30秒。